O型血的红细胞膜上含有
A. A抗原
B. B抗原
C. O抗原
D. H抗原
E. D抗原

正确答案：D。H抗原